根尖周病最常见的原因是
A. 外伤
B. 化学刺激
C. 电流刺激
D. 细菌感染
E. 免疫因素

正确答案：D。细菌感染

解析：感染根管内细菌：主要细菌是厌氧菌，尤其是专性厌氧菌，包括类杆菌（如产黑色素杆菌和不产黑色素杆菌）、梭杆菌、真杆菌、丙酸杆菌、消化链球菌和放线菌等，都与根尖周病的发生和发展有密切关系。掌握“根尖周病概述”知识点。